以下哪个面是点隙窝沟龋的好发部位
A. 上颌中切牙的唇面
B. 上颌侧切牙的邻面
C. 上颌侧切牙的舌窝
D. 下颌中切牙的舌面
E. 下颌侧切牙的唇面

正确答案：C。上颌侧切牙的舌窝

解析：上颌侧切牙的舌侧窝，为点隙、沟裂分布的部位，是龋最好发的部位。掌握“龋病的临床表现与分类”知识点。